对胎儿生长发育有损伤的因素是
A. 生物性因素
B. 先天性因素
C. 遗传性因素
D. 营养性因素
E. 免疫性因素

正确答案：B。先天性因素

解析：对胎儿生长发育有损伤的因素是先天性因素（B对）。